中等强度作业的特点是
A. 氧需等于氧上限
B. 氧需不超过氧上限
C. 氧需超过氧上限
D. 氧债几乎等于氧需
E. 氧债等于氧需

正确答案：B。氧需不超过氧上限